女，65岁。发热2个月，诊断为亚急性感染性心内膜炎，给予大剂量抗生素治疗，体温未能控制，突发腰痛5小时，可见肉眼血尿。腹部X线平片和泌尿系统B超未见异常。该患者突发腰痛的最可能原因是
A. 肾梗死
B. 并发泌尿道感染
C. 局灶性肾炎
D. 抗生素过敏
E. 合并急性肾炎

正确答案：A。肾梗死

解析：患者老年女性，发热2个月，亚急性感染性心内膜炎（IE）（肾梗死病因）大剂量抗生素治疗后体温未能控制（提示菌血症未得控制）。突发腰痛，肉眼血尿（肾梗死典型临床表现），腹部X线平片和泌尿系统B超未见异常（初步排除原发性肾脏疾病）。结合患者病史、临床表现，考虑最可能的诊断为IE肾脏并发症：肾梗死（A对）。泌尿道感染（B错）多为上行感染，病原菌为大肠埃希菌，老年女性高发，临床表现为尿频、尿急、尿痛等尿路刺激征。该病与IE并无直接关联。局灶性肾炎（C错）患者全身症状不明显，肉眼血尿少见。